医师行使道德权利的特点之一是
A. 强制性
B. 自主性
C. 冲动性
D. 组织性
E. 集体性

正确答案：B。自主性